心尖部的体表投影在
A. 右侧第3肋软骨上缘近胸骨处
B. 右侧第6胸肋关节处
C. 左侧第5肋间距前正中线7~9cm处
D. 左侧第5肋间距前正中线1~2cm处
E. 左侧锁骨中线第4肋间

正确答案：C。左侧第5肋间距前正中线7~9cm处

解析：左侧第5肋间距前正中线7-9cm处（C对）即左侧第5肋间隙锁骨中线（D错）内侧1-2cm处为心尖部的体表投影。